传导精细触觉的是
A. 脊髓丘脑侧束
B. 脊髓丘脑前束
C. 薄束和楔束
D. 脊髓小脑前束
E. 脊髓小脑后束

正确答案：C。薄束和楔束

解析：薄束和楔束（C对）传导精细触觉；脊髓丘脑侧束（A错）主要传递痛、温觉信息；脊髓丘脑前束（B错）主要传递粗触觉、压觉信息；脊髓小脑前束（D错）和脊髓小脑后束（E错）传递下肢和躯干下部的非意识性本体感觉和触、压觉信息至小脑。